持续性房颤是指难以自动转复为窦性心律的房颤发作持续
A. 持续时间＞7天，非自限性
B. 72小时以上
C. 1个月以上
D. 3个月以上
E. 6个月以上

正确答案：A。持续时间＞7天，非自限性

解析：七版内科学的房颤分类：急性房颤是指初次发作的房颤，且在24～48小时以内。慢性房颤是指房颤病史＞3个月，又分为阵发性、持续性及永久性房颤3类。阵发性房颤是指房颤间断发作，每次发作持续时间＜24～48小时，多为自限性。持续性房颤是指房颤持续发作时间在24～48小时以上，多不能自行终止发作。⑤永久房颤是指持续时间1年以上。九版内科学房颤临床新分类：①首诊房颤：首次确诊（首次发作或首次发现）；②阵发性房颤：持续时间≤7天（常≤48小时），能自行终止；③持续性房颤：持续时间＞7天，非自限性（A对）；④长期持续性房颤：持续时间≥1年，患者有转复愿望；⑤永久性房颤：持续时间＞1年，不能终止或终止后又复发，无转复愿望。